柴葛解肌汤与大柴胡汤的组成药物中均含有的是
A. 枳实、芍药
B. 桔梗、芍药
C. 黄芩、半夏
D. 黄芩、桔梗
E. 黄芩、芍药

正确答案：E。黄芩、芍药

解析：柴葛解肌汤功能解肌清热，由柴胡、干葛、甘草、黄芩、羌活、白芷、芍药、桔梗组成。大柴胡汤功能和解少阳，内泻热结，由柴胡、黄芩、芍药、半夏、生姜、枳实、大枣、大黄组成（E对）。